引起过敏反应的主要血液成分是
A. 红细胞
B. 血浆
C. 淋巴细胞
D. 血小板
E. 中性粒细胞

正确答案：B。血浆

解析：引起过敏反应的主要是血浆（B对）中的蛋白类物质与免疫球蛋白（以IgA为主），当病人多次输血后，体内会产生多种抗异物抗体，再次输血时这些抗体会与输入血中的蛋白类物质或免疫球蛋白结合，发生过敏反应。